适用于急症治疗的丸药是
A. 水丸
B. 水蜜丸
C. 小蜜丸
D. 滴丸
E. 浓缩丸

正确答案：D。滴丸

解析：本题考查的是滴丸的特点。适用于急症治疗的丸药是滴丸（D对）。滴丸，即用滴制法制成的丸剂，系指原料药与适宜的基质加热熔融混匀，滴入不相混溶、互不作用的冷凝介质中制成的球形或类球形制剂。滴丸的生物利用度高，尤其是难溶性药物，在水溶性基质中高度分散可形成固体分散体，溶出速度快，奏效迅速，适用于急症治疗。水丸（A错）习称水泛丸，系指饮片细粉以水（或根据制法用黄酒、醋、稀药汁、糖液、含5%以下炼蜜的水溶液等）为黏合剂制成的丸剂。较易溶散，吸收、显效较快，尤适于中药解表和消导制剂。水蜜丸（B错）系指饮片细粉以炼蜜和水为黏合剂制成的丸剂。小蜜丸（C错）属于蜜丸。蜜丸系指饮片细粉以炼蜜为黏合剂制成的丸剂。其中每丸重量在0.5g以下的称小蜜丸。蜂蜜具有润肺止咳、润肠通便、解毒等作用。蜜丸常作为滋补药剂，或用作慢性疾病治疗。水蜜丸除具备上述特点外，尚具有丸粒小、光滑圆整，易于吞服、节省蜂蜜、降低成本、利于贮存的特点。浓缩丸（E错）系指饮片或部分饮片提取浓缩后，与适宜的辅料或其余饮片细粉，以水、炼蜜或炼蜜和水为黏合剂制成的丸剂。具有体积和服用剂量小，易于吸收，服用、携带及贮存方便等优点。